男性，50岁。既往乙型肝炎病史20余年，今晨突发呕血，色鲜红，量约为1500ml，急至医院就诊，查体：BP80/50mmHg，P106次/分，面色苍白，四肢末梢凉，脾于肋下缘5cm可触及，移动性浊音（+），腹壁可见静脉曲张，至医院后患者又呕血一次，量约300ml.下列哪项与患者主要疾病关系不大
A. 食管胃底静脉曲张
B. 腹壁静脉曲张
C. 痔
D. 腹膜后静脉曲张
E. 大隐静脉曲张

正确答案：E。大隐静脉曲张

解析：中年患者乙肝病史20余年（可发展为肝炎后肝硬化），脾肋下缘5cm（脾大），移动浊音阳性（腹水），腹壁可见静脉曲张（门静脉高压严重），根据临床表现及病史，诊断为肝硬化。门脉高压征是肝硬化患者表现之一。肝硬化导致正常的肝内静脉通路受阻，使门静脉系与腔静脉系之间的交通支扩张、扭曲形成静脉曲张，包括：食管胃底静脉（A错）曲张、腹壁静脉（B错）曲张、直肠下端、肛管交通支曲张形成痔（C错）、腹膜后静脉曲张（D错）。大隐静脉属于下肢浅静脉，起自足背静脉网内侧，最后注入股总静脉，与门脉系统不产生直接联系。大隐静脉曲张（E对）与患者肝硬化导致的门脉高压症关系不大。